查纤溶异常的化验是
A. 出血时间
B. 纤维蛋白原定量
C. 血块收缩试验
D. 3P试验
E. 血小板计数

正确答案：D。3P试验

解析：能反映纤溶异常的化验是3P试验（D对）。纤溶活性主要由纤溶酶原、纤溶酶数量及功能等决定。3P试验又叫血浆鱼精蛋白副凝固试验，其原理是在受检血浆中加入硫酸鱼精蛋白溶液，若血浆中存在可溶性纤维蛋白单体与纤维蛋白降解产物复合物时，则鱼精蛋白可使其解离析出纤维蛋白单体，纤维蛋白单体自行聚成肉眼可见的纤维状物，此为阳性结果。因此，3P试验（P285）可以反映纤溶功能是否异常强弱。出血时间（A错）主要受血小板数量及功能影响，其次受血管壁完整性与收缩性的影响。纤维蛋白原定量（P293）（B错）实验主要反映机体的凝血功能。血块收缩试验（P288）（C错）是通过检测析出血清的容积来评价血小板的收缩能力的试验。血小板计数（P287）（E错）试验主要反映血小板的数量情况。